不是病原体的免疫逃逸免疫抑制机制的是
A. 干扰宿主的抗原递呈
B. 干扰抗感染细胞因子，补体功能
C. 直接杀伤免疫细胞
D. 利用宿主体内免疫隔离部位
E. 髓过氧化物酶（MPO）介导的杀伤机制

正确答案：E。髓过氧化物酶（MPO）介导的杀伤机制

解析：髓过氧化物酶（MPO）介导的杀伤机制为人类中性粒细胞依氧杀菌机制。掌握“抗感染免疫”知识点。